有关酶Km值的叙述正确的是Km值
A. 是酶-底物复合物的解离常数
B. 与酶的结构无关
C. 与底物的性质无关
D. 并不反映酶与底物的亲和力
E. 等于最大反应速度一半时的底物浓度

正确答案：E。等于最大反应速度一半时的底物浓度

解析：米氏方程式：V=Vmax[S]/（Km+[S]），当反应速率为最大速率一半时，米氏方程式可以变换为：Vmax/2=Vmax[S]/（Km+[S]），进一步整理得Km=[S]，故Km值等于酶促反应速率为最大反应速率一半时的底物浓度（E对）。Km值是酶的特征性常数，只与酶的结构（B错）、底物的性质（C错）和反应环境（如温度、PH、离子强度）有关。Km=（k₂+k₃）/k₁（k₁是酶与底物生成中间产物反应的速率常数，k₂是中间产物解离成酶和底物反应的速率常数，k₃是中间产物分解成酶和产物反应的速率常数），只有当k₃«k₂时，Km≈k₂/k₁，Km才相当于是酶-底物复合物的解离常数（A错），此时Km代表酶对底物的亲和力（D错）。